糖尿病最常见最严重的急性并发症是
A. 心血管病变
B. 非特异性感染
C. 肺结核
D. 酮症酸中毒
E. 低血糖昏迷

正确答案：D。酮症酸中毒

解析：糖尿病酮症酸中毒为糖尿病最常见最严重的急性并发症（D对），主要表现为高血糖、酮症和酸中毒，是胰岛素不足和拮抗胰岛素激素过多共同作用所致的严重代谢紊乱综合征。心血管病变（A错）、非特异性感染（B错）、低血糖昏迷（E错）为糖尿病慢性并发症。肺结核不是糖尿病并发症（C错）。